内囊位于
A. 豆状核、尾状核和屏状核之间
B. 豆状核、尾状核和背侧丘脑之间
C. 豆状核、尾状核和壳之间
D. 豆状核、背侧丘脑和纹状体之间
E. 苍白球、尾状核和背侧丘脑之间

正确答案：B。豆状核、尾状核和背侧丘脑之间

解析：内囊位于豆状核、尾状核和背侧丘脑之间（B对）。